下列哪项符合漏出液的特点
A. 外观呈血性
B. 比重>1.018
C. 能自凝
D. 白细胞计数>0.5×109/L
E. 无病原菌

正确答案：E。无病原菌

解析：漏出液常无细菌（E对）。漏出液颜色为淡黄色（A错），比重＜1.015（B错），一般不易凝固（C错），白细胞计数＜0.1×109/L（D错）。